根据《非处方药专有标识管理规定（暂行）》，可以单色印刷非处方药专有标识的是
A. 标签和内包装
B. 使用说明书和大包装
C. 标签和使用说明书
D. 内包装和大包装
E. 标签和大包装

正确答案：B。使用说明书和大包装

解析：本题考查的是非处方药专有标识的管理。根据《非处方药专有标识管理规定（暂行）》，可以单色印刷非处方药专有标识的是使用说明书和大包装（B对）。非处方药专有标识的管理：非处方药专有标识是用于已列入《国家非处方药目录》，并通过药品监督管理部门审核登记的非处方药药品标签、使用说明书、内包装、外包装的专有标识，也可用作经营非处方药药品的企业指南性标志。我国非处方药专有标识图案为椭圆形背景下的OTC 3个英文字母的组合，这也是国际上对非处方药的习惯称谓。非处方药专有标识图案分为红色和绿色，红色专有标识用于甲类非处方药品，绿色专有标识用于乙类非处方药品和用作指南性标志。使用非处方药专有标识时，药品的使用说明书和大包装可以单色印刷，标签和其他包装（ACDE错）必须按照国家药品监督管理部门公布的色标要求印刷。单色印刷时，非处方药专有标识下方必须标示“甲类”或“乙类”字样。非处方药专有标识应与药品标签、使用说明书、内包装、外包装一体化印刷，其大小可根据实际需要设定，但必须醒目、清晰，并按照国家药品监督管理部门公布的坐标比例使用。非处方药药品标签、使用说明书和每个销售基本单元包装印有中文药品通用名称（商品名称）的一面（侧），其右上角是非处方药专有标识的固定位置。